为了减少高血压对社区一般人群和高危人群健康的影响，某社区计划开展一项高血压的健康教育活动，下列不适于本次活动的教育内容是
A. 遵医服药
B. 膳食限盐
C. 控制体重
D. 应激处理训练
E. 定期测量血压

正确答案：A。遵医服药